某女，70岁。患中风与子宫脱垂数年，症见乏力倦怠、半身不遂。证属中气下陷、气虚血滞，宜选用的药是
A. 黄精
B. 西洋参
C. 女贞子
D. 黄芪
E. 刺五加

正确答案：D。黄芪

解析：本题考查的是黄芪的主治病证。某女，70岁。患中风与子宫脱垂数年，症见乏力倦怠、半身不遂。证属中气下陷、气虚血滞，宜选用的药是黄芪（D对）。黄芪：【主治病证】（1）脾胃气虚，脾肺气虚，中气下陷，气不摄血，气虚发热。（2）自汗，盗汗。（3）气血不足所致的疮痈不溃或溃久不敛。（4）气虚水肿、小便不利。（5）气血双亏，血虚萎黄，血痹肢麻，半身不遂，消渴。黄精（A错）：【主治病证】（1）肺虚燥咳，劳嗽久咳。（2）肾虚精亏之腰膝酸软、须发早白、头晕乏力。（3）气虚倦怠乏力，阴虚口干便燥。（4）气阴两虚，内热消渴。西洋参（B错）：【主治病证】（1）阴虚热盛之咳嗽痰血。（2）热病气阴两伤之烦倦。（3）津液不足之口干舌燥，内热消渴。女贞子（C错）：【主治病证】（1）肝肾阴虚之头晕目眩、腰膝酸软、须发早白。（2）阴虚发热。（3）肝肾虚亏之目暗不明，视力减退。刺五加（E错）：【主治病证】（1）脾虚乏力，食欲不振，气虚浮肿。（2）肾虚腰膝酸软，小儿行迟。（3）心悸气短，失眠多梦，健忘。（4）胸痹心痛，痹痛日久，跌打肿痛。